与肺炎链球菌致病性密切相关的细菌结构是
A. 荚膜
B. 质粒
C. 普通菌毛
D. 芽孢
E. 鞭毛

正确答案：A。荚膜

解析：荚膜（A对）是肺炎链球菌的主要毒力因子。有荚膜的肺炎链球菌抵抗力强，荚膜有抗吞噬作用，当有荚膜的光滑（S）型细菌失去荚膜成为粗糙的（R）型时，其毒力减低或消失。质粒（B错）是细菌染色体外的遗传物质，控制细菌某些特定的遗传性状，其编码的细菌性状有菌毛、细菌素、毒素和耐药性的产生等，不是引起细菌致病的结构（P16）。普通菌毛（C错）细菌的黏附结构，与细菌的致病性相关，但不是肺炎链球菌的主要毒力因子。肺炎链球菌无鞭毛（E错），无芽孢（D错）。